小儿正常舌象是
A. 淡白
B. 绛红
C. 紫暗
D. 暗红
E. 淡红

正确答案：E。淡红

解析：小儿舌质淡白为气血亏虚（A错）。舌质绛红为温病热入营血（B错）。舌紫暗为气血瘀滞（C错）。舌暗红也为病理状态的舌质，多为热盛阴伤等（D错）。正常小儿舌体柔软、淡红润泽（E对）。